胎黄属湿热熏蒸宜选用
A. 血府逐瘀汤
B. 茵陈蒿汤
C. 茵陈理中汤
D. 茵陈栀子汤
E. 一贯煎

正确答案：B。茵陈蒿汤

解析：胎黄属湿热熏蒸者是由于湿热邪毒蕴结脾胃，熏蒸肝胆，以致胆汁外溢皮肤、面目所致，治疗时应清热利湿退黄，首选茵陈蒿汤（B对）。血府逐瘀汤（A错）的功用为活血化瘀，行气止痛，适用于胸中瘀血证。茵陈理中汤（C错）的功用为温中健脾，利湿退黄，适用于胎黄之寒湿阻滞证。茵陈栀子汤（D错）的功用为清热解毒，利湿退黄，适用于黄疸之热重于湿证。一贯煎（E错）的功用为的功用为滋阴疏肝，主治肝肾阴虚，肝气郁滞证。